修复性牙本质是
A. 在成牙本质细胞和矿化牙本质之间是一层未钙化的牙本质
B. 牙本质钙质小球之间遗留的未钙化间质
C. 在冠部靠近釉质和根部靠近牙骨质最先形成的部分
D. 牙齿发育完成后形成的牙本质
E. 釉质表面因磨损、酸蚀、龋病等而遭受破坏时，部分成牙本质细胞继续形成的牙本质

正确答案：E。釉质表面因磨损、酸蚀、龋病等而遭受破坏时，部分成牙本质细胞继续形成的牙本质

解析：本题考查修复性牙本质。釉质表面因磨损、酸蚀、龋病等而遭受破坏时，牙髓深层未分化细胞取代变性细胞，与部分尚有功能的成牙本质细胞形成修复性牙本质（E对）。在成牙本质细胞和矿化牙本质之间有一层未钙化的牙本质，为前期牙本质（A错）。牙本质钙质小球之间遗留的未钙化间质，为球间牙本质（B错）。在冠部靠近釉质和根部靠近牙骨质最先形成的部分，为原发性牙本质（C错）。牙齿发育完成后形成的牙本质，为继发性牙本质（D错）。